噬菌体的遗传物质
A. RNA
B. DNA
C. 质粒
D. DNA和RNA
E. RNA或DNA

正确答案：E。RNA或DNA

解析：噬菌体具有病毒的生物学性状，即个体微小，结构简单，只含有一种核酸DNA或RNA，只能在活的细胞内以复制方式进行增殖。掌握“噬菌体性状及分类”知识点。